关于CIN的描述下列哪项是错误的
A. CIN属于癌前病变
B. CINⅢ级属于早期癌
C. CINⅢ级即原位癌
D. CINⅠ级等于不典型增生Ⅰ级
E. CINⅡ级等于不典型增生Ⅱ级

正确答案：C。CINⅢ级即原位癌

解析：宫颈癌的癌前病变（ CIN ）（A对）包括宫颈不典型增生及宫颈原位癌，这两种病变是宫颈浸润癌的癌前病变，统称为CIN。CIN（子宫颈上皮内瘤变）是指从子宫颈上皮异型增生到原位癌这一连续过程，可分为Ⅰ、Ⅱ、Ⅲ级，CINⅠ级等于不典型增生Ⅰ级（D对）；CINⅡ级等于不典型增生Ⅱ级（E对）；CINⅢ级包括Ⅲ级异型增生和原位癌（C错，为本题正确答案）。早期癌是指癌组织浸润局限于黏膜层或黏膜下层的癌，包括原位癌，故CINⅢ级属于早期癌（B对）。